位于两侧声襞及杓状软骨基底部之间
A. 喉前庭
B. 喉中间腔
C. 声门下腔
D. 声门裂
E. 前庭裂

正确答案：D。声门裂

解析：声门裂位于两侧声襞及杓状软骨基底部之间（D对）。